男性，马车翻车时砸伤下腹部，查体：耻骨联合处压痛，挤压试验阳性，膀胱胀满，橡皮导管插入一定深度未引出尿液，导管尖端见血迹，此时应考虑
A. 导尿管插入深度不足
B. 导尿管插入方法不对
C. 导尿管阻塞
D. 骨盆骨折并尿道断裂
E. 骨盆骨折合并膀胱损伤

正确答案：D。骨盆骨折并尿道断裂

解析：患者有车祸史，砸伤下腹部后，耻骨联合处压痛、挤压试验阳性（提示可能有骨盆骨折），膀胱胀满，橡皮导管插入一定深度未引出尿液、导管尖端见血迹（提示尿道断裂），结合患者病史、临床表现和体查，该患者此时应考虑为骨盆骨折合并尿道断裂（D对）。患者膀胱胀满，说明没有膀胱损伤（E错）。导尿管插入深度不足（A错）、导尿管插入方法不对（B错）、导尿管阻塞（C错）虽均可致引不出尿液，但并非该患者膀胱胀满的原因。